产自特定区域，比其他地区的同种中药材品质和疗效更好的是
A. 道地药材
B. 鲜用药材
C. 野生或半野生药用动植物
D. 自采自种自用中草药

正确答案：A。道地药材

解析：本题考查的是道地药材。产自特定区域，比其他地区的同种中药材品质和疗效更好的是道地药材（A对）。中药材种植、养殖管理：国家鼓励培育道地中药材。对集中规模化栽培养殖，质量可以控制并符合国家药品监督管理部门规定条件的中药材品种，实行批准文号管理。国家建立道地中药材评价体系，支持道地中药材品种选育，扶持道地中药材生产基地建设，加强道地中药材生产基地生态环境保护，鼓励采取地理标志产品保护等措施保护道地中药材。道地药材源自特定产区、具有独特药效，需要在特定地域内生产。鲜用药材（B错）：可采用冷藏、砂藏、罐贮、生物保鲜等适宜的保鲜方法，尽可能不使用保鲜剂和防腐剂。野生或半野生药用动植物（C错）的采集应坚持“最大持续产量”原则，“最大持续产量”即不危害生态环境，可持续生产（采收）的最大产量。自采自种自用中草药（D错）：自种、自采、自用中草药是指乡村中医药技术人员自己种植、采收、使用，不需特殊加工炮制的植物中草药。